男，15岁，1个月前因学习退步被班主任批评后，渐起入睡困难，早醒，伴有情绪低落，自觉能力差，对前途悲观绝望，怀疑同学看不起他，嘲笑他，常自责，觉得对不起父母的培养，称活得太累，计划趁家人不备自杀。有时焦躁不安，用拳头砸墙发泄情绪。如果在治疗过程中患者出现好管闲事、兴奋话多、自我感觉良好，应调整治疗方案为
A. 减少抗抑郁药合并苯二氮卓类
B. 减少抗抑郁药剂量继续维待
C. 心境稳定剂治疗为主
D. 抗抑郁药合并抗精神病药
E. 加大抗抑郁药剂量

正确答案：C。心境稳定剂治疗为主

解析：患者男性青少年，情绪低落，意志活动减退，思维迟缓，负性认知模式（抑郁发作典型症状）；自责自罪，有自杀观念和行为，间或感到焦虑（精神病性症状）；有睡眠障碍，精力下降，砸拳发泄（躯体症状群），为典型抑郁发作；在治疗过程中出现好管困事、兴奋话多、自我感觉良好（躁狂典型临床表现），综合患者临床表现，既有抑郁发作又有躁狂发作，诊断为双相障碍。治疗应遵守：综合治疗原则、个体化治疗原则、心境稳定剂为基础治疗原则及联合用药治疗原则（C对）：包括多种心境稳定剂联合；心境稳定剂与苯二氮卓类药物联用；与抗精神病药物连联用（D错）；与抗抑郁药联用。常见额心境稳定剂为：锂盐、卡马西平和丙戊酸盐。